非处方药中解热镇痛药用于止痛时，限定疗程为
A. 服用1日
B. 服用3日
C. 服用5日
D. 服用7日
E. 服用10日

正确答案：C。服用5日